既温肾壮阳，又祛寒除湿的药是
A. 仙茅
B. 海马
C. 蜂蜜
D. 狗脊
E. 龙眼肉

正确答案：A。仙茅

解析：本题考查的是仙茅的功效。既温肾壮阳，又祛寒除湿的药是仙茅（A对）。仙茅：【功效】补肾壮阳，强筋健骨，祛寒除湿。海马（B错）：【功效】补肾助阳，活血散结，消肿止痛。蜂蜜（C错）：【功效】补中缓急，润肺止咳，滑肠通便，解毒。狗脊（D错）：【功效】补肝肾，强腰膝，祛风湿。龙眼肉（E错）：【功效】补心脾，益气血，安心神。